制备缓释固体分散体常用的载体材料是
A. 明胶
B. 乙基纤维素
C. 磷脂
D. 聚乙二醇
E. β-环糊精

正确答案：B。乙基纤维素

解析：本题考查制备缓释固体分散体常用的载体材料。不溶性骨架材料是指不溶于水或水溶性极小的高分子聚合物或无毒塑料等。常用的有乙基纤维素（EC）（B对）、聚乙烯、无毒聚氯乙烯、乙烯-醋酸乙烯共聚物、硅橡胶等。明胶（A错）是制备微囊常用的囊材。磷脂（C错）是制备脂质体的膜材。聚乙二醇（D错）是固体分散体的水溶性载体材料。β-环糊精（E错）是制备包合物的包合材料。